关于噬菌体生化性状叙述错误的是
A. 有严格的宿主特异性
B. 有三种基本形态
C. 主要由核酸和蛋白质组成
D. 具有病毒的基本特性
E. 抵抗力比一般细菌弱

正确答案：E。抵抗力比一般细菌弱